医师在执业活动中享受的权利
A. 保护患者隐私
B. 履行医师职责
C. 从事医学研究
D. 遵守技术规范
E. 遵守职业道德

正确答案：C。从事医学研究

解析：《执业医师法》规定，医师在执业活动中享有从事医学研究（C对）、学术交流，参加医师协会和专业学术团体的权利。《执业医师法》规定，医师在执业活动中应当履行下列义务（P248）：①遵守法律、法规，遵守技术规范（D错）；②树立敬业精神，遵守职业道德（E错），履行医师职责（B错），尽职尽责为患者服务；③关心、爱护、尊重患者，保护患者的隐私（A错）。